每克食物碳水化合物在体内代谢产生能量为
A. 2.39kJ
B. 4.18kJ
C. 16.8kJ
D. 37.6kJ
E. 33.4kJ

正确答案：C。16.8kJ